64岁男性患者，反复咳嗽、咯痰，痰中带血2周。体温38.3℃，WBC12×10⁹/L，胸片右肺门肿块影，伴远端大片状阴影，抗炎治疗阴影不吸收。有助于尽快明确诊断的检查首选
A. CT
B. 磁共振
C. 胸腔镜
D. 纤支镜
E. 核素扫描

正确答案：D。纤支镜

解析：老年男性患者，咳嗽咯痰、痰中带血，虽有体温升高、白细胞增高（正常值4～10×10⁹/L），但抗炎治疗病变阴影不吸收（提示非肺部感染，考虑可能为肺癌所致感染），胸片示肿块影位于右肺门，结合患者病史、临床表现和影像学检查，该患者最可能的诊断为右侧中心型肺癌。患者已行X线检查，为尽快明确诊断首选的检查是纤支镜检查（D对），纤支镜不仅可观察到气管和支气管中的病变，还可在直视下钳取病变组织送检，从而获得病理证据。胸腔镜（C错）多用于周围型肺癌的确诊检查。CT（A错）、磁共振（B错）、核素扫描（E错）均为影像学检查，可用于肺癌的辅助诊断，但均不能确诊肺癌。